来源于十字花科植物播娘蒿干燥成熟种子的中药材是
A. 牵牛子
B. 菟丝子
C. 南葶苈子
D. 北葶苈子
E. 鹤虱

正确答案：C。南葶苈子